心身疾病的治疗原则，不包括
A. 药物缓解治疗
B. 自我心理调节
C. 矫正不良习惯
D. 不间断发泄
E. 心理护理

正确答案：D。不间断发泄

解析：心身疾病的治疗中，既要心理干预，又要心身同治。心理干预的目标是消除心理社会刺激因素、消除心理学病因、消除生物学症状，应视不同层次、不同方法、不同目的而决定，支持疗法、环境控制、松弛训练、生物反馈、认知治疗、行为矫正疗法（C对）和家庭疗法等心理治疗方法均可选择，也可自我心理调节（B对）、心理护理（E对）等。心身疾病治疗中，对于具体病例，心身治疗应各有侧重。对于急性发病并且躯体症状严重的患者，应以躯体对症治疗为主，药物缓解症状（A对），辅之以心理治疗。部分患者虽然以躯体症状为主但已呈慢性过程的心身疾病，则可在实施常规躯体治疗的同时，重点安排好心理治疗。发泄应根据患者情况，适度适量进行（D错，为本题正确答案）。